封闭式问题的优点是
A. 易于数据整理分析
B. 费时
C. 回答者应有较高的语言表达能力
D. 回答者能充分发表自己的看法
E. 无法归类编码

正确答案：A。易于数据整理分析